肾上腺素对心脏的作用不包括下列哪一项
A. 收缩力增强
B. 传导加快
C. 自律性增加
D. 耗氧量增加
E. 减少心肌代谢

正确答案：E。减少心肌代谢

解析：肾上腺素属于α、β受体激动剂，作用于心肌、传导系统和窦房结的β₁、β₂受体，加强心肌收缩力（A对），加速传导（B对），加速心率，增加心输出量，还能舒张冠状血管，改善心肌的血液供应，是一个快速而强效的心脏兴奋剂，不利的方面是提高心肌代谢（E错，为本题正确答案），使心肌耗氧量增加（D对），提高了心脏的自律性（C对），注射过快或剂量过大可引起心律失常，出现期前收缩，甚至心室纤颤。